属于不稳定性骨折的是
A. 嵌插骨折
B. 青枝骨折
C. 横骨折
D. 裂缝骨折
E. 斜形骨折

正确答案：E。斜形骨折

解析：不稳定性骨折指骨折端易发生移位的骨折，包括斜形骨折（E对）、螺旋形骨折、粉碎性骨折等。稳定性骨折指骨折端不易发生移位的骨折，包括裂缝骨折（D错）、青枝骨折（B错）、横行骨折（C错）、压缩性骨折、嵌插骨折（A错）等。